下列有关种植体骨结合在骨内的组织反应的叙述中，正确的是
A. 第一阶段时种植体植入后表面被血块包绕，进一步有骨髓内生物高分子吸附，形成适应层
B. 第二阶段为术后1个月为组织破坏与增生同时发生的修复期
C. 第三阶段时种植体周围开始胶原纤维形成，以后形成网状纤维结构，逐步完成骨结合
D. 骨结合其在骨内的组织反应分三个阶段
E. 以上均正确

正确答案：E。以上均正确

解析：骨结合其在骨内的组织反应分三个阶段：第一阶段：种植体植入后表面被血块包绕，进一步有骨髓内生物高分子吸附，形成适应层。第二阶段：术后1个月为组织破坏与增生同时发生的修复期。第三阶段：至术后3个月，种植体周围开始胶原纤维形成，以后形成网状纤维结构，逐步完成骨结合。掌握“牙种植术概论”知识点。